32岁，女性，妊娠31周，少量阴道流血，以往曾有3次早产史。主要处理应是
A. 抑制宫缩，促进胎儿肺成熟
B. 左侧卧位
C. 注意休息，并给以镇静剂
D. 任其自然
E. 氧气吸入，给予止血剂

正确答案：A。抑制宫缩，促进胎儿肺成熟

解析：青年女性，妊娠晚期有少量阴道流血（前置胎盘的典型表现为妊娠晚期无痛性阴道流血），以往曾有3次早产史（多次刮宫史是前置胎盘发生的高危因素），可初步诊断为前置胎盘，另外该孕妇妊娠31周（＜34周），应采取期待疗法，抑制宫缩以延长孕周和促胎肺成熟（A对D错）；如患者阴道流血多，应氧气吸入，给予止血剂（E错）；左侧卧位（B错），卧床休息为一般处理；必要时可给予镇静剂（C错）。